软胶囊囊壁由干明胶、干增塑剂、水三者构成，其重量比例通常是
A. 1∶（0.2～0.4）∶1
B. 1∶（0.2～0.4）∶2
C. 1∶（0.4～0.6）∶1
D. 1∶（0.4～0.6）∶2
E. 1∶（0.4～0.6）∶3

正确答案：C。1∶（0.4～0.6）∶1